属于抗胆碱药，易透过血-脑屏障，能有效预防晕动病的药物
A. 托烷司琼
B. 东莨菪碱
C. 苯海拉明
D. 氟哌啶醇
E. 阿瑞匹坦

正确答案：B。东莨菪碱

解析：本题考查东莨菪碱。属于抗胆碱药，易透过血脑屏障，能有效预防晕动病的药物是东莨菪碱（B对）。东莨菪碱脂溶性较强，能通过血脑屏障产生中枢抑制，临床上用于全身麻醉前给药、预防和控制晕动症；托烷司琼（A错）为中枢神经系统5-羟色胺（5-HT₃）受体的强效、高选择性的竞争拮抗剂，适用于预防和治疗癌症化疗引起的恶心和呕吐；苯海拉明（C错）为H₁组胺受体拮抗药，可缓解组胺所致的过敏反应；氟哌啶醇（D错）是多巴胺受体拮抗药，作用于多巴胺受体起到抗精神分裂的作用；阿瑞匹坦（E错）是口服的神经激肽（NK-1）受体阻断剂，常与糖皮质激素和5-羟色胺3（5-HT₃）受体阻断剂组成三药联合方案，预防高致吐性化疗药物引起的急性和迟发性恶心、呕吐。